2015年某市为了调查老年人中多发病的分布情况，对该市7个区的9个不同地段抽取60岁及以上的老年人7458例进行调查，这是
A. 分析性研究
B. 抽样调查
C. 普查
D. 筛检
E. 发病率调查

正确答案：B。抽样调查